气不摄血可见
A. 刺痛难忍，固定不移
B. 头晕眼花，心悸怔忡
C. 闷胀疼痛
D. 胀痛刺痛
E. 面白乏力，皮下出血

正确答案：E。面白乏力，皮下出血

解析：气不摄血多由于久病伤脾，气虚失于统摄血液所致。脾虚气不摄血的病变，主要表现为脾不统血所致的皮下紫癜、咳血、吐血、便血、尿血、崩漏等，以病势较缓，血色淡而质稀，多淋漓不断为特征。兼见面色无华、倦怠乏力、舌淡、脉虚无力等气虚的表现（E对）。血瘀主要表现为血液运行郁滞不畅，或形成瘀积，瘀血致病疼痛特点表现为局部刺痛，固定不移（A错），也可表现为胀痛刺痛（D错）。血虚指血液不足，血的濡养功能减退的病机变化，临床可见头晕眼花，心悸怔忡，面色苍白，唇舌爪甲色淡无华，脉细弱等症（B错）。气滞于某一经络或局部，可出现相应部位的胀满、疼痛（C错）。